肾功能不全患者应避免使用的饮片是
A. 华山参
B. 川楝子
C. 青风藤
D. 天仙藤
E. 五味子

正确答案：D。天仙藤

解析：本题考查的是对肾功能有影响的中药。肾功能不全患者应避免使用的饮片是天仙藤（D对）。常见对肾功能有影响的植物类中药：（1）含生物碱类：近年来发现，不但雷公藤、草乌、益母草、蓖麻子、麻黄、北豆根等均可导致急性肾功能衰竭，而且含上述中药的一些制剂也可引起肾损害甚至急性肾功能衰竭。（2）含马兜铃酸类：马兜铃、天仙藤、寻骨风等均含马兜铃酸，中毒可致肾小管坏死出现面部浮肿，渐至全身水肿、尿频尿急，甚至出现急、慢性肾功能衰竭及尿毒症而死亡。（3）含挥发油类：部分芳香类药物的肾毒性可能与其挥发油类成分相关，如土荆芥、藿香、茵陈、艾叶等。（4）含蒽醌类：研究显示，大黄蒽醌类成分（大黄、番泻叶、芦荟）具有潜在的肝肾毒性和致癌性。（5）苷类：苍耳子含苍术苷或羧基苍术苷可导致近端肾小管坏死、肝中心小叶坏死。华山参（A错）有毒，用量0.1～0.2g。孕妇慎用。不宜多服；青光眼者禁服；前列腺重度肥大者慎用。川楝子（B错）是含萜类肝脏毒性中药中最典型的一类药物，能引起急性中毒性肝炎，出现转氨酶升高、黄疸、肝肿大。青风藤（C错）无毒。五味子（E错）：用时捣碎。